细菌在生物学分类上属于
A. 真核生物类
B. 原核生物类
C. 单核生物类
D. 多核生物类
E. 无核生物类

正确答案：B。原核生物类